可摘局部义齿修复适用于下列情况，除了
A. 各种牙列缺损，包括游离端缺失者
B. 缺牙伴牙槽骨，颌骨和软组织缺损者
C. 基牙一度松动、牙槽骨吸收1/3
D. 基牙的固定形态过差者
E. 牙列缺损的过渡性修复

正确答案：D。基牙的固定形态过差者

解析：本题考查可摘局部义齿的适应证。可摘局部义齿修复除了基牙的固定形态过差者（D错，为本题的正确答案）。可摘局部义齿适应证很广泛，从个别牙缺失到只剩一个牙齿均可用可摘局部义齿修复，所以各种牙列缺损，包括游离端缺失者（A对）均可适用。缺牙伴牙槽骨，颌骨和软组织缺损者（B对），可以用可摘局部义齿的人工牙修复牙齿缺失，用基托来恢复骨和软组织缺损。可以作为牙列缺损的过渡性修复（E对），促进拔牙创的愈合。可摘局部义齿主要靠基牙提供固位.支持.稳定，基牙一度松动、牙槽骨吸收1/3（C对）可以提供足够的固位、支持、稳定，使义齿发挥功能，属于适应证，但是基牙的固定形态过差者义齿无法获得固位，是不适用的。